心力衰竭合并肾衰竭患者利尿药物首选
A. 阿米洛利
B. 氨苯蝶啶
C. 呋塞米
D. 螺内酯
E. 氢氯噻嗪

正确答案：C。呋塞米

解析：利尿剂是心力衰竭治疗中改善症状的基石，是心衰治疗中唯一能够控制体液潴留的药物。心力衰竭合并肾衰竭患者利尿药物首选袢利尿剂，以呋塞米（速尿）（C对）为代表，其作用于髓袢升支粗段，排钠排钾，为强效利尿剂。阿米洛利（A错）、氨苯蝶啶（B错）和螺内酯（D错）都属于贮钾利尿剂；氢氯噻嗪（E错）属于噻嗪类利尿剂，噻嗪类利尿剂及贮钾利尿剂因疗效甚差，并可致药物蓄积而应避免应用于心力衰竭合并肾衰竭患者。